某20年历史陶瓷厂近年发现多例肺癌，为了尽早确定肺癌的发病是否因接触粉尘引起的，最合适的研究方法是
A. 病例对照研究
B. 生态学研究
C. 前瞻性队列研究
D. 历史性队列研究
E. 现场实验研究

正确答案：D。历史性队列研究

解析：本题考查历史性队列研究的概念。历史性队列研究（D对ABCE错）是指研究对象的分组是根据研究开始时研究者已掌握的有关研究对象在过去某个时点的暴露状况的历史材料做出的，研究开始时研究的结局已经出现，不需要前瞻性观察的一种设计模式。本题中已经有了多个病例，且以往资料较容易获得，符合历史性队列研究的特点。